若以成年男性血红蛋白低于120g/L为贫血的判断标准，调查某地成年男性1000人，记录每人是否患有贫血，结果有19名贫血患者，981名非贫血患者，则该资料的类型为
A. 定量资料
B. 二项分类资料
C. 有序多分类资料
D. 无序多分类资料
E. 可看作定性资料，也可看作定量资料

正确答案：B。二项分类资料

解析：本题考查数据类型的相关内容。无序分类变量（ACE错）的各个取值间则没有程度的差异，比如性别、血型。对于无序分类变量，根据取值的不同又可分为二项分类变量和多项分类变量，根据成年男性是否贫血分为贫血患者及非贫血患者，则该资料为二项分类资料（B对D错）。